男性，27岁。心悸气短，胸闷胸痛晕厥。查体：胸骨左缘第3肋间3/6收缩期杂音，超声检查显示室间隔：左室后壁为1.5：1，SAM（+）。超声心动图SAM征指的是
A. 二尖瓣前叶收缩期向前运动
B. 二尖瓣后叶与前叶同向运动
C. 三尖瓣前叶舒张期向前运动
D. 三尖瓣后叶舒张期向后运动
E. 主动脉瓣收缩期向前运动

正确答案：A。二尖瓣前叶收缩期向前运动

解析：超声心动图SAM征指的是在M型超声诊断中的一个征象，系二尖瓣前叶收缩期前向运动（A对BCDE错），指梗阻性肥厚型心肌病在收缩期CD段不是一个缓慢的上升平台，而出现一个向上（向室间隔方向）突起的异常波形，这种现象称为收缩期前向运动（SAM）。